女性，5岁。因发热、头痛、呕吐2天于2月3日入院。体检：神志恍惚，口唇单纯疱疹，皮肤上有大小不等的瘀斑，少数融合成片，本病例的诊断应首先考虑
A. 流行性乙型脑炎
B. 钩端螺旋体病脑膜脑炎型
C. 流行性出血热
D. 脑型疟疾
E. 流行性脑脊髓膜炎

正确答案：E。流行性脑脊髓膜炎

解析：患者5岁儿童，冬季发病（流行性脑脊髓膜炎冬、春季高发），口唇出现单纯疱疹（为细菌感染表现），皮肤有瘀斑（细菌引起小血管栓塞导致），有头痛、呕吐、神志恍惚（细菌侵犯中枢神经系统），根据患儿的临床症状等表现，本病例的诊断应首先考虑流行性脑脊髓膜炎（流脑）（E对）。流行性乙型脑炎（A错）由乙脑病毒引起，在温带地区主要以夏秋季流行为主，主要侵犯中枢神经系统，表现为高热、头痛、意识障碍、抽搐和脑膜刺激征等，严重者可进一步发展为昏迷、中枢性呼吸衰竭或脑疝（P279）。钩端螺旋体病脑膜炎型（B错）由钩端螺旋体引起，为钩端螺旋体感染后中期器官损伤期，在起病后3～10天出现严重头痛、烦躁、颈抵抗、布氏征、克氏征阳性等脑膜炎表现，以及嗜睡、神志不清、谵妄、抽搐、瘫痪、昏迷等脑炎表现，严重者可发生脑水肿、脑疝及呼吸衰竭，早期钩端螺旋体主要表现为全身感染中毒症状（八版传染病学P255-256）。流行性出血热（肾综合征出血热）（C错）由汉坦病毒引起，其发生和流行具有明显的地区性和季节性，与宿主动物的分布和活动相关，典型病例具有三大主症：发热、出血、肾脏损害（P288-P289）。脑型疟疾（D错）是由疟原虫引起的，是恶性疟的严重临床类型，主要的临床表现为剧烈头痛、发热，常出现不同程度的意识障碍，同时伴有典型的突发性寒战、高热和大量出汗等症状（八版传染病学P283）。